两种化学物质产生联合作用的毒物为各单项化学物质毒性的总和称为
A. 相加作用
B. 协同作用
C. 独立作用
D. 拮抗作用
E. 综合作用

正确答案：A。相加作用

解析：本题考查相加作用。两种化学物质产生联合作用的毒物为各单项化学物质毒性的总和称为相加作用（A对BCDE错）。